非水碱量法中所用的指示液是
A. 结晶紫
B. 碘化钾-淀粉
C. 荧光黄
D. 酚酞
E. 邻二氮菲

正确答案：A。结晶紫

解析：本题考查非水碱量法。非水碱量法的指示剂为结晶紫（A对）。碘化钾-淀粉（B错）是碘量法使用的指示剂。荧光黄（C错）是吸附指示剂法使用的指示剂。酚酞（D错）可以作为酸碱滴定的指示剂。邻二氮菲（E错）是铈量法的指示剂。